智齿牙冠朝向下颌牙的根方，牙根朝向下颌牙的冠方时称
A. 近中阻生
B. 水平阻生
C. 垂直阻生
D. 远中阻生
E. 倒置阻生

正确答案：E。倒置阻生

解析：本题考查倒置阻生。关于阻生智齿的命名临床分类方法很多，其中Winter根据阻生智牙的长轴与第二磨牙长轴的关系，将阻生智牙命名为以下7种：垂直阻生；水平阻生；近中阻生；远中阻生；颊向阻生；舌向阻生；倒置阻生。其中智齿牙冠朝向下颌牙的根方，牙根朝向下颌牙的冠方时称倒置阻生（E对）；近中阻生（A错）为智齿牙冠向下颌牙的近中，牙根向下颌牙的远中；反之为远中阻生（D错）；水平阻生（B错）为智齿牙长轴与下颌第二磨牙长轴接近垂直，在颌骨内横向生长，牙冠朝向近中，牙根朝向远中；垂直阻生（C错）为智齿牙长轴与下颌第二磨牙长轴接近平行，牙冠牙根方向与下颌第二磨牙同向。